女，50岁，2小时前烧伤双侧臀部、双下肢（不包括双足），皮肤明显红肿，疼痛较剧，伤处布满大小水疱，内含黄色液体，去疱皮见创面红润、潮湿。血压等生命体征正常。估计该患者烧伤深度及面积是
A. Ⅲ°，47%
B. Ⅲ°，40%
C. 浅Ⅱ°，40%
D. 浅Ⅱ°，47%
E. 深Ⅱ°，47%

正确答案：C。浅Ⅱ°，40%

解析：女性患者，双侧臀部（6%）、双下肢（不包括双足）（双大腿21%+双小腿13%），烧伤面积一共40%。患者局部红肿明显，疼痛明显，有大小不一的水疱形成，内含淡黄色液体，水疱皮剥脱后，创面红润、潮湿，烧伤深度为浅Ⅱ°（C对）。I度烧伤：仅伤及表皮浅层，生发层健在。表面红斑状、干燥，烧灼感。深Ⅱ度烧伤：伤及真皮乳头层以下，但仍残留部分网状层，深浅不尽一致，也可有水疱，但去疱皮后，创面微湿，红白相间，痛觉较迟钝。Ⅲ度烧伤：全层皮肤烧伤，可深达肌肉甚至骨骼、内脏器官等。创面蜡白或焦黄，甚至炭化。硬如皮革，干燥，无渗液，发凉，针刺和拔毛无痛觉。